指导-合作型的生物医学模式特征是
A. 医生为病人做什么
B. 医生教会病人做什么
C. 医生帮助病人自我恢复
D. 配合病人做什么
E. 告诉病人做什么

正确答案：B。医生教会病人做什么

解析：指导-合作型这是一种微弱单向、以生物心理社会医学模式为指导思想的医患关系，其特征是“医生教会病人做什么”。掌握“医患沟通的理论、技术与其应用以及医患关系模式”知识点。